药物引起口腔黏膜产生变态反应炎症的途径是
A. 口服
B. 注射
C. 含漱
D. 局部涂搽
E. 以上都是

正确答案：E。以上都是

解析：药物过敏性口炎是药物通过口服、注射或局部涂搽、含漱等不同途径进入机体内，使过敏体质者发生变态反应而引起的黏膜及皮肤的变态反应性疾病。掌握“药物过敏性口炎”知识点。